可激活补体的是
A. KIR
B. KAR
C. TCR
D. MBL
E. CEA

正确答案：D。MBL

解析：补体是一个具有精密调控机制的蛋白质反应系统，其固有成分以非活化形式存在于体液中，通过级联酶促反应而被激活，产生具有生物学活性的产物。有三条激活途径：经典途径、旁路途径和MBL途径。MBL（D对）是指血浆中甘露糖结合凝集素，是凝集素途径的激活物，可激活补体。KIR（A错）是杀伤细胞免疫球蛋白样受体，属Ig超家族成员，传递抑制信号。KAR（B错）是杀伤细胞活化受体。TCR（C错）是T细胞抗原受体，可结合抗原。MBL（D对）是指血浆中甘露糖结合凝集素，是凝集素途径的激活物，可激活补体。CEA（E错）是癌胚抗原，属于肿瘤相关抗原，用于检测胃肠道肿瘤。